急性肾盂肾炎的主要病机是
A. 湿热蕴结下焦，膀胱气化不利
B. 湿热蕴结中焦，膀胱气化失司
C. 湿热蕴结肝胆，肝胆疏泄失常
D. 肾气亏虚，肾失蒸化开阖
E. 肾阴亏虚，湿热蕴结

正确答案：A。湿热蕴结下焦，膀胱气化不利

解析：急性肾盂肾炎属于上尿路感染，发病部位处于下焦，故其主要病机应为湿热蕴结下焦，膀胱主管尿液排泄，应为膀胱气化不利（A对）。